药品说明书撰写原则
A. 真实性
B. 灵活性
C. 一致性
D. 理论性
E. 丰富性

正确答案：A、C。真实性；一致性

解析：本题考查药品说明书撰写原则。药品说明书撰写原则：真实性（A对）、一致性（C对）。药品说明书是指药品生产企业印制并提供的，包含药理学、毒理学、药效学、医学等药品安全性、有效性重要科学数据和结论的，用以指导临床正确使用药品的技术资料。其撰写原则必须保持真实性和一致性，不能夸大宣传或者单独强调理论依据、实验数据都是不妥的。灵活性（B错）、理论性（D错）、丰富性（E错）不作为药品说明书撰写的原则。